仅限于整复下颌骨体部的中小型缺损的是
A. 单纯游离骨移植术
B. 成形性松质骨移植术
C. 带肌蒂的骨移植术
D. 血管吻合游离骨移植术
E. 多元性游离骨移植术

正确答案：C。带肌蒂的骨移植术

解析：带肌蒂的骨移植术其缺点是转移方向受到一定限制，骨段的长度也不能随心所欲，仅限于整复下颌骨体部的中小型缺损。掌握“骨移植”知识点。